饭后困倦嗜睡，少气懒言的临床意义是
A. 痰湿困脾
B. 脾气不足
C. 心肾阳虚
D. 热入营血
E. 心肾不交

正确答案：B。脾气不足

解析：食后谷气不消，脾阳困顿，清阳不升，神气不爽，故困顿欲睡，少气懒言，常因饮食失调，脾胃气虚（B对），运化无力引起；痰湿困脾易导致困倦嗜睡，头目昏沉，胸闷脘痞，肢体困重等症状（A错）；心肾阳虚多导致精神极度疲惫，神识朦胧，困倦易睡，肢冷脉微等症状（C错）；热入营血（D错），心肾不交（E错）常导致失眠。